某男，60岁。症见胸闷、心悸、头晕、头痛、颈项疼痛。医师处以心可舒胶囊。此因该中成药除能活血化瘀外，又能
A. 养血止痛
B. 通脉止痛
C. 散寒止痛
D. 行气止痛
E. 缓急止痛

正确答案：D。行气止痛

解析：本题考查心可舒胶囊的功能。此因该中成药除能活血化瘀外，又能行气止痛（D对）。心可舒胶囊（片）【功能】活血化瘀，行气止痛。妇科十味片【功能】养血舒肝，调经止痛（A错）。丹七片【功能】活血化瘀，通脉止痛（B错）。少腹逐瘀丸（颗粒、胶囊）【功能】温经活血，散寒止痛（C错）。小建中合剂【功能】温中补虚，缓急止痛（E错）。